具有抗炎作用，可用于各型肝炎治疗的药物是
A. 异甘草酸镁
B. 多烯磷脂酰胆碱
C. 双环醇
D. 门冬氨酸钾镁
E. 腺苷蛋氨酸

正确答案：A。异甘草酸镁

解析：本题考查药物的适应证。异甘草酸镁（A对）通过各种机制发挥抗炎作用，有类似激素的作用，临床应用于各型肝炎的治疗；多烯磷脂酰胆碱（B错）为必需磷酯类肝胆疾病辅助用药，用于以肝细胞膜损害为主的急慢性肝炎、药物性肝炎、酒精性肝病、中毒性肝炎；双环醇（C错）用于治疗慢性肝炎所致的氨基转移酶升高；门冬氨酸钾镁（D错）属于电解质补充药；腺苷蛋氨酸（E错）为利胆药，可促进胆汁分泌，减轻胆汁瘀滞，临床用于治疗自身免疫性肝炎以及胆汁性肝硬化、硬化性胆管炎等各种胆汁淤积症。